患者47岁，近二年月经周期紊乱，血量多，此次又阴道流血20余天，伴头晕，心悸，查体：轻度贫血貌，子宫、附件正常对上述病人，下步处置应为
A. 止血芳酸
B. 大量雌激素
C. 大剂量雄激素
D. 诊刮
E. 大量孕激素

正确答案：D。诊刮

解析：本病例很可能为更年期功血，对于更年期功血患者进行刮宫可起到既能诊断又能止血的作用，故为首选。答案为D。掌握“功能失调性子宫出血”知识点。